女，2岁。腹泻3天，诊断为重型腹泻，经静脉补充有效量的3：2：1液治疗，脱水明显纠正，尿量增加，但患儿仍有腹胀，精神差，肌张力低。首先需考虑
A. 低钠血症
B. 低钾血症
C. 低钙血症
D. 低镁血症
E. 低氯血症

正确答案：B。低钾血症

解析：患儿因严重腹泻导致脱水，补液时未补钾，丢失的钾离子未得到补充且血液被稀释后钾离子浓度更低了，同时患者出现腹胀、肌张力低的低钾症状，故首先考虑低钾血症（B对）。